职业卫生与职业医学的基本任务主要是
A. 提高职业卫生科学水平
B. 积极防治职业病
C. 识别、评价、预测和控制不良劳动条件
D. 检测、评价和消除不良劳动条件
E. 提高劳动生产率

正确答案：C。识别、评价、预测和控制不良劳动条件